对MRSA引起的肺炎，首选的抗生素是
A. 青霉素G
B. 头孢唑啉
C. 苯唑西林
D. 万古霉素
E. 头孢呋辛

正确答案：D。万古霉素

解析：万古霉素（D对）对G⁺菌产生强大的杀菌作用，尤其对耐甲氧西林的金黄色葡萄球菌（MRSA）、MRSE高度敏感，是治疗MRSA引起肺炎的首选药。青霉素G（A错）（P369）为治疗敏感革兰氏阳性球菌和杆菌革兰氏阴性球菌及螺旋体所致感染的首选药。头孢唑林（B错）（P373）是第一代头孢菌素，易被葡萄球菌产生的的β-内酰胺酶所破坏。苯唑西林（C错）为耐青霉素酶青霉素，对产青霉素酶的葡萄球菌具有良好抗菌活性，对各种链球菌及不产青霉素酶的葡萄球菌抗菌活性则逊于青霉素G。头孢呋辛（E错）（P373）为第二代头孢菌素，对G⁺的作用不及第一代，对G⁻有明显的抑制作用。